水中毒时体液的流动
A. 由细胞外至细胞内
B. 由细胞内至细胞外
C. 由组织间隙至血管内
D. 由血管内至淋巴管内
E. 不移动

正确答案：A。由细胞外至细胞内

解析：水中毒的特点是患者水潴留使体液量明显增多，血钠下降，水自细胞外向渗透压相对高的细胞内转移（A对E错）。高渗性脱水时体液由细胞内至细胞外（B错）。低渗性脱水时体液由组织间隙至血管内（C错）。